常用动物类中药的药用部位有动物的干燥整体、除去内脏的干燥体、动物体的某一部分、动物的生理产物、动物的病理产物、动物体某一部分的加工品等。其中，药用部位为动物生理产物的药材有
A. 牛黄
B. 僵蚕
C. 珍珠
D. 麝香
E. 蟾酥

正确答案：D、E。麝香；蟾酥

解析：本题考查常用动物类中药的药用部位。药用部位为动物的生理产物的是麝香（D对）、蟾酥（E对）。动物的生理产物分泌物：如麝香、蟾酥、熊胆粉、虫白蜡、蜂蜡等。动物的病理产物：如僵蚕（A错）、珍珠（B错）、牛黄（C错）、马宝、猴枣、狗宝等。